对血钾影响较小，对糖耐量和脂质代谢无不良影响的利尿剂是
A. 布美他尼
B. 依他尼酸
C. 呋塞米
D. 托拉塞米
E. 吲达帕胺

正确答案：E。吲达帕胺

解析：本题考查吲达帕胺。对血钾影响较小，对糖耐量和脂质代谢无不良影响的利尿剂是吲达帕胺（E对）。吲达帕胺为噻嗪样作用利尿药，噻嗪样利尿剂氯噻酮、吲达帕胺对血钾的影响很小。吲达帕胺不良反应较噻嗪类轻，高尿酸血症的发生率也低于噻嗪类，对糖耐量和脂质代谢无不良影响。布美他尼（A错）不良反应与水、电解质紊乱有关、尤其是大剂量或长期应用时，如体位性低血压、体克、低钾血症、低氯血症、低氯性碱中毒、低钠血症、低钙血症以及与此有关的口渴、乏力、肌肉酸痛、心律失常等。依他尼酸（B错）是一种对于磺胺类药物有严重过敏史的患者可选择的利尿剂。呋塞米（C错）用于治疗水肿性疾病，当起始治疗剂量未达到满意的治疗效果时，可追加剂量，每日最大剂量可达600mg。但一般应控制在100mg以内。托拉塞米（D错）的不良反应有头晕、头痛、恶心、虚弱、呕吐、高血糖、排尿过多、高尿酸血症、低钾血症、极度口渴、血容量不足、阳萎、食道出血、消化道不良等。